缓解非格司亭所致骨痛，可选择
A. 碳酸钙
B. 布洛芬
C. 腺嘌呤
D. 对乙酰氨基酚
E. 葡萄糖酸钙

正确答案：B、D。布洛芬；对乙酰氨基酚

解析：本题考查缓解非格司亭所致骨痛的药。缓解非格司亭所致骨痛，可选择布洛芬（B对）和对乙酰氨基酚（D对）。对乙酰氨基酚为非甾体抗炎药，对轻中度疼痛有效；布洛芬有解热镇痛作用，能够治疗非格司亭引起的发热、头痛、肌痛。